环磷酰胺对下列哪种肿瘤疗效最好
A. 多发性骨髓瘤
B. 恶性淋巴瘤
C. 急性淋巴细胞白血病
D. 乳腺癌
E. 卵巢癌

正确答案：B。恶性淋巴瘤

解析：本题考查环磷酰胺的适应症。环磷酰胺对下列恶性淋巴瘤（B对）疗效最好。环磷酰胺是目前广泛应用的抗癌药物，环磷酰胺对易感恶性肿瘤单独有效，更常与其他抗肿瘤药联合使用，环磷酰胺主要用于治疗恶性淋巴瘤、多发性骨髓瘤（A错）、急性或慢性淋巴细胞白血病（C错）、乳腺癌（D错）、卵巢癌（E错），众多适应症中对恶性淋巴瘤疗效最好。